1880年普鲁士政府制定保障工人健康的医疗保险和事故保险政策的领导人是
A. 南丁格尔
B. 俾斯麦
C. 桑德斯
D. 巴斯德
E. 科赫

正确答案：B。俾斯麦

解析：1880年开始，俾斯麦领导的普鲁士政府制定了保障工人健康的医疗保险和事故保险政策。在法国一些著名的医生提出了关注人们健康的思想，并成为法国大革命的核心内容之一。此外，在健康权利观念形成过程中，医学界也扮演了重要的角色。19世纪末，著名医学家，如巴斯德和科赫发起了争取大众健康以及职业权利的运动。掌握“健康伦理”知识点。